贫血或甲亢患者常有心尖区收缩期杂音，其产生的主要机制是
A. 血流加速
B. 瓣膜口狭窄
C. 瓣膜关闭不全
D. 异常通道
E. 心脏内有漂浮物

正确答案：A。血流加速

解析：贫血或甲亢患者血流速度增快（A对），血流速度越快，就越容易才升漩涡，就越容易产生杂音。瓣膜口狭窄（B错）为二尖瓣狭窄、主动脉瓣狭窄、肺动脉瓣狭窄、先天性主动脉缩窄等杂音产生的机制。瓣膜关闭不全（C错）为二尖瓣关闭不全、主动脉瓣关闭不全（D错）等杂音产生的机制。异常通道（E错）是室间隔缺损、动脉导管未闭等杂音产生的机制。心脏内有漂浮物为心内膜炎时心脏杂音产生的机制。